假设检验中，犯第Ⅰ类、第Ⅱ类错误的概率α、β间的关系有
A. α+β=1
B. α＞β
C. α＜β
D. 增加样本量是同时减少α及β的唯一方法
E. 若α确定，β也能确定

正确答案：D。增加样本量是同时减少α及β的唯一方法